属于斯德哥尔摩公约中被控制或消除的持久性有机污染物是
A. 苯并（a）芘
B. 多氯联苯
C. 林丹
D. 六六六
E. 硫丹

正确答案：B。多氯联苯

解析：本题考查斯德哥尔摩公约中被控制或消除的持久性有机污染物。斯德哥尔摩公约是一项国际环境公约，旨在控制和消除持久性有机污染物的污染。本题中多氯联苯（B对ACDE错）是斯德哥尔摩公约中被控制或消除的持久性有机污染物之一。多氯联苯是一种有毒物质，具有致癌、免疫抑制和神经毒性等毒性特征，而且具有持久性，在大气、水和土壤中存在时间长，而且不易降解，容易污染水体，对人体健康和环境危害极大。此外，多氯联苯在许多工业生产过程中都有使用，比如，用于制造油漆、塑料、火柴、橡胶等。